社会医学的任务不包括
A. 倡导积极的健康观，保护和促进人群的身心健康和社会适应能力
B. 开展社区卫生服务
C. 研究自然环境、生活居住环境与人群健康的关系
D. 推进医学模式的转变，促进卫生事业发展
E. 开展社会卫生状况的调查研究，提出改善卫生状况的对策与措施

正确答案：C。研究自然环境、生活居住环境与人群健康的关系

解析：本题考查社会医学的任务。我国社会医学的任务包括：1.倡导积极的健康观，保护和促进人群的身心健康和社会适应能力（A对）；2.开展社区卫生服务（B对）；3.推进医学模式的转变，促进卫生事业发展（D对）；4.开展社会卫生状况的调查研究，提出改善卫生状况的对策与措施（E对）。研究自然环境、生活居住环境与人群健康的关系（C错，为本题正确答案）不属于社会医学的任务。